蛋白质和多肽的吸收具有一定的部位特异性，其主要吸收方式是
A. 简单扩散
B. 滤过
C. 膜动转运
D. 主动转运
E. 易化扩散

正确答案：C。膜动转运

解析：本题考查药物的转运方式。膜动转运（C对）是蛋白质和多肽的重要吸收方式，并且有一定的部位特异性；简单扩散（A错）是分子顺浓度梯度通过生物膜；滤过（B错）为药物分子借助流体静压或渗透压随体液通过细胞膜的水性通道穿过生物膜；主动转运（D错）是借助膜上载体逆浓度梯度转运；易化扩散（E错）是借助载体顺浓度梯度转运，不消耗能量。